下列说法正确的是
A. 吸收、分布和排泄具有共性，统称为生物转化。
B. 代谢称为生物转运。
C. 代谢过程与吸收过程合称为消除。
D. ADME各过程之间存在密切的关联，彼此相互影响，通常可以同时发生。

正确答案：D。ADME各过程之间存在密切的关联，彼此相互影响，通常可以同时发生。

解析：本题考查生物转运与生物转化。机体对于化学毒物的处置包括吸收、分布、代谢和排泄四个过程（又称ADME过程）。其中吸收、分布和排泄具有共性，即都是化学毒物穿越生物膜的过程，其本身的结构和性质不发生变化，故统称为生物转运（A错）。代谢则不同，是化学毒物在细胞内发生一系列化学结构和理化性质改变而转化为新衍生物的过程，故称之为生物转化（B错）。由于化学毒物转化为新衍生物与其被排泄到体外的结果都是使其原形在体内的数量减少，故代谢与排泄过程又合称为消除（C错）。ADME各过程之间存在密切关联，彼此相互影响，通常可以同时发生（D对）。